患者，男，65岁，突感上腹部剧烈疼痛，取硝酸甘油片含服，未能缓解。查体：脸色青白，血压80／60mmHg(10.67／7.98kPa)，除心率140次／分外，心肺听诊无异常，腹平软，无压痛、反跳痛，肠鸣音存在。应首先考虑的是
A. 胃痉挛
B. 胃穿孔
C. 急性胰腺炎
D. 心绞痛
E. 心肌梗死

正确答案：E。心肌梗死

解析：老年男性，突感上腹部剧烈疼痛，取硝酸甘油片含服，未能缓解。查体：脸色青白，血压80／60mmHg(10.67／7.98kPa)，除心率140次／分外（血压降低，心率增快），心肺听诊无异常，腹平软，无压痛、反跳痛，肠鸣音存在（无腹膜炎征象），心绞痛（D错）时服用硝酸甘油可缓解，该患者可排除，因此首先考虑的是心肌梗死（E对）。患者腹部触诊及听诊正常可排除胃痉挛（A错）、胃穿孔（B错）及急性胰腺炎（C错）。